半夏炮制品中善于止呕的是
A. 半夏曲
B. 清半夏
C. 姜半夏
D. 法半夏
E. 生半夏

正确答案：C。姜半夏

解析：本题考查半夏的炮制作用。半夏炮制品中善于止呕的是姜半夏（C对）。半夏【炮制作用】半夏味辛，性温；有毒。归脾、胃、肺经。具有化痰止咳、消肿散结的功能。①生半夏（E错）有毒，使人呕吐，咽喉肿痛，失音，一般不做内服，多做外用，用于疮痈肿毒，湿痰咳嗽。②半夏经炮制后，能降低毒性，缓和药性，消除副作用。③清半夏（B错）长于化痰，以燥湿化痰为主，用于湿痰咳嗽，痰热内结，风痰吐逆，痰涎凝聚，咯吐不出。④姜半夏增强了降逆止呕作用，以温中化痰、降逆止呕为主，用于痰饮呕吐，胃脘痞满。⑤法半夏（D错）偏于祛寒痰，同时具有调和脾胃的作用，多用于痰多咳嗽，痰饮眩悸。亦多用于中药成方制剂中。半夏曲（A错）【炮制作用】半夏曲味甘、微辛，性温。归脾、胃经。半夏经发酵制成曲剂后，可增强健脾温胃、燥湿化痰的功能。麸炒半夏曲，产生焦香气，增强健胃消食的作用。